霍乱的大便性状是
A. 黏液脓血便
B. 柏油便
C. 米泔样便
D. 蛋花汤样便
E. 血水样便

正确答案：C。米泔样便

解析：霍乱肠毒素可刺激隐窝细胞分泌水、氯化物及碳酸氢盐的功能增强，同时抑制绒毛细胞对钠的正常吸收，以致大量水分和电解质聚集在肠腔，形成本病特征性的剧烈水样腹泻。霍乱肠毒素还能促使肠黏膜杯状细胞分泌黏液增多，使腹泻的水样便中含大量黏液。此外，腹泻导致的失水使胆汁分泌减少，因而腹泻排出的大便可呈“米泔水”样（C对）。黏液脓血便（A错）为急性细菌性痢疾典型的大便性状。柏油样便（B错），尤其伴有呕血时，是上消化道出血的典型表现。病毒性肠炎或致病性大肠杆菌肠炎可使大便呈蛋花汤样改变（D错）。血水样便（E错）多见于痔疮。